下列关于翼下颌间隙的描述中，错误的是
A. 位于下颌支与翼内肌之间
B. 又称翼颌间隙
C. 前界为颞肌及颊肌
D. 后界为腮腺
E. 上界为眶下缘

正确答案：E。上界为眶下缘

解析：翼下颌间隙（翼颌间隙）位于下颌支与翼内肌之间。前界为颞肌及颊肌，后界为腮腺，上界为翼外肌下缘，下以翼内肌附着于下颌支处为界。掌握“面侧深区及颌面部各间隙的境界”知识点。